25岁女性患者要求前牙美观治疗。查：上、下前牙有不同程度的散在的黄褐色及白垩状斑，部分唇面釉质有缺损，探硬，光滑，该患牙治疗原则
A. 内脱色
B. 外脱色
C. 复合树脂贴面修复
D. 牙髓治疗后桩冠修复
E. 以上均可以

正确答案：C。复合树脂贴面修复

解析：本题考查氟牙症的防治原则。25岁女性患者要求前牙美观治疗。查：上、下前牙有不同程度的散在的黄褐色及白垩状斑，部分唇面釉质有缺损，探硬，光滑，该患牙治疗原则为复合树脂贴面修复（C对）。患者上、下前牙有不同程度的散在的黄褐色及白垩状斑，部分唇面釉质有缺损，探硬，光滑，考虑为氟牙症。对于仅有釉质染色的氟牙症可应用磨除、酸蚀涂层法，该患者的患牙唇面釉质有缺损，应进行复合树脂贴面修复。对于多数牙冠比较完整、染色为轻、中度的四环素牙，漂白法应为首选；根据给药途径，漂白法可分为内漂白和外漂白两种（AB错）。患牙为氟牙症，牙髓正常，无需进行牙髓治疗（D错）。